肉毒碱-脂酰转移酶Ⅱ存在于
A. 线粒体内膜内侧
B. 线粒体内膜外侧
C. 线粒体基质
D. 线粒体基粒
E. 线粒体膜间隙

正确答案：A。线粒体内膜内侧

解析：线粒体内膜外侧含有肉毒碱-脂酰转移酶Ⅰ，内侧含有肉毒碱-脂酰转移酶Ⅱ，二者为同工酶。掌握“脂肪的分解代谢”知识点。